下述阑尾的位置，最常见的是
A. 回肠前位，回肠后位
B. 回肠下位，盲肠后位
C. 盆位部扩大称直肠壶腹
D. 有凸向背侧的会阴曲
E. 无

正确答案：B。回肠下位，盲肠后位

解析：阑尾位置较多，但以回肠下位和盲肠后位(A错B对)较多见，直肠壶腹为直肠上结构，其为向下肠腔的显著膨大(C错)，会阴曲也为直肠上结构，其为凸向前方的弓形弯曲(D错)。